下列判断疾病地方性依据正确的是
A. 当地对该病易感的动物也可能发生类似的疾病
B. 迁出该地区的居民，该病的发病率下降
C. 外来的健康人，到达当地一定时间后发病
D. 该病在当地居住的各人群组中发病率均高，并随年龄增长而上升
E. 以上说法均正确

正确答案：E。以上说法均正确

解析：判断疾病地方性的依据是：①该病在当地居住的各人群组中发病率均高，并随年龄增长而上升；②在其他地区居住的相似的人群组中，该病的发病率均低，甚至不发病；③外来的健康人，到达当地一定时间后发病，其发病率逐渐与当地居民接近；④迁出该地区的居民，该病的发病率下降，患者症状减轻或呈自愈趋向；⑤当地对该病易感的动物也可能发生类似的疾病。掌握“流行病学资料与疾病分布”知识点。